牛黄不具有的功效是
A. 清热解毒
B. 息风止痉
C. 利水通淋
D. 化痰
E. 开窍

正确答案：C。利水通淋

解析：本题考查的是牛黄的功效。牛黄不具有的功效是利水通淋（C错，为本题正确答案）。牛黄：【功效】清热解毒（A对），息风止痉（B对），化痰（D对）开窍（E对）。利水通淋为车前子的功效。车前子：【功效】利水通淋，渗湿止泻，明目，清肺化痰。